平均重量大于3.0的栓剂，允许的重量差异限度是
A. 0.01
B. 0.03
C. 0.05
D. 0.1
E. 0.15

正确答案：C。0.05

解析：本题考查栓剂重量差异限度。栓剂平均重量≤1.0g时，栓剂允许的重量差异限度为±10％。栓剂平均重量＞1.0g且≤3g时，栓剂允许的重量差异限度为±7.5％。栓剂平均重量＞3.0g时，栓剂允许的重量差异限度为±5％（C对）。